感染后易转为慢性的痢疾杆菌是
A. 志贺痢疾杆菌
B. 福氏痢疾杆菌
C. 宋内痢疾杆菌
D. 鲍氏痢疾杆菌
E. 舒氏痢疾杆菌

正确答案：B。福氏痢疾杆菌

解析：我国以福氏和宋内志贺菌为主，经济发达地区宋内志贺菌逐渐占优势。福氏志贺菌感染易转为慢性（B对）；宋内志贺菌感染往往症状较轻（C错），多呈不典型发作；痢疾志贺菌的毒力最强，病情最重（A错）。